肾盂结石1.2cm，IVP右肾功能正常，轻度积水，输尿管通畅，首选的治疗方法是
A. 中药排石
B. 消炎止痛
C. 手术取石
D. 体外震波碎石
E. 大量饮水

正确答案：D。体外震波碎石

解析：本例患者肾盂结石1.2cm，IVP右肾功能正常，输尿管通畅，首选的治疗方法是体外震波碎石（D对）。中药排石（A错）、大量饮水（E错）一般用于结石较小、能够自行排出的患者。消炎止痛（B错）用于尿路结石并发感染时的治疗。手术取石（C错）创伤较大，现在已很少使用。上尿路结石治疗方案现总结如下：直径＜0.6cm的结石，药物治疗；0.6cm≤直径≤2cm的肾结石及输尿管上段结石，体外冲击波碎石（ESWL）治疗；直径＞2cm的肾结石，经皮肾镜碎石取石术（PCNL）治疗；直径＜2cm的中下段输尿管结石，输尿管镜取石术（URL）治疗；直径＞2cm的输尿管结石，腹腔镜输尿管取石（LUL）治疗。